豁免强制标示营养标签的预包装食品为
A. 饼干
B. 罐头
C. 薯片
D. 包装饮用水
E. 糕点

正确答案：D。包装饮用水

解析：本题考查豁免强制标示营养标签的预包装食品。豁免强制标示营养标签的预包装食品为：1.生鲜食品，如包装的生肉、生鱼、生蔬菜和水果、禽蛋等；2.乙醇含量≥0.5%的饮料酒类；3.包装总表面积≤100cm²或最大表面面积≤20cm²的食品；4.现制现售的食品；5.包装的饮用水（D对ABCE错）；6.每日食用量≤l0g或10ml的预包装食品；7.其他法律法规标准规定可以不标示营养标签的预包装食品。